以下关于牙本质粘接的难点，叙述正确的是
A. 酸蚀脱矿后牙本质内大量胶原纤维塌陷
B. 酸蚀处理后釉质表面活化能提高
C. 使用磷酸进行蚀刻
D. 除去玷污层又不损伤牙髓牙本质复合体
E. 牙本质的矿化程度较釉质低，有机物和水含量较釉质低

正确答案：D。除去玷污层又不损伤牙髓牙本质复合体

解析：牙本质在制洞时经高热磨削，切下的牙本质微屑中有机物变性，与被切断小管的溢出液、唾液和一些微生物相混合黏附于洞壁，形成牙本质玷污层，也称微屑层或涂层，并可进入牙本质小管形成管塞，用一般清水冲洗或刮除等方法，不能除去。牙本质玷污层的存在，大大干扰了粘接材料与牙本质直接密合，影响对牙本质的粘接。因此，要求除去玷污层又不损伤牙髓牙本质复合体，是牙本质粘接的重要环节。掌握“树脂粘结概念及釉质、牙本质粘结”知识点。